食品腐败变质的最终结果是
A. TVBN升高
B. 二甲胺降低
C. 食品营养价值降低
D. 酸度升高
E. 皂化价降低

正确答案：C。食品营养价值降低